某地区有10万人口，1960年总死亡人数1000名，已发现的结核病患者有300名，男性200名，女性有100名，1960年有60名死于结核病，其中50名为男性，该地区粗死亡率为
A. 300/10万
B. 60/1000
C. 10/995
D. 100/1000
E. 10/10000

正确答案：C。10/995

解析：本题考查粗死亡率的计算。粗死亡率的计算公式中，分子为死亡人数，分母为该人群同期平均人口数，即粗死亡率＝1000/（（100000+99000）×0.5）＝10/995（C对ABDE错）≈1%。